肝硬化患者出现血性腹水，但无腹痛及发热应首先考虑的合并症是
A. 腹膜炎
B. 肝肾综合征
C. 原发性肝癌
D. 门静脉血栓形成
E. 结核性腹膜炎

正确答案：C。原发性肝癌

解析：肝硬化并发肝癌，会出现肝脏进行性增大，腹水呈血性，持续肝区疼痛，出现不规则的发热等（C对）。典型腹膜炎合并者出现发热、腹痛、腹胀，腹围迅速增大，腹壁有压痛和反跳痛，腹水混浊（A错）。肝肾综合征合并者的特点为为自发性少尿或无尿、氮质血症、稀释性低钠血症和低尿钠（B错）。并发门静脉血栓者，急性或亚急性发作时，可出现不同程度的腹胀痛、肠坏死、消化道出血及肝性脑病等（D错）。若感染结核杆菌，临床主要表现为倦怠、发热、腹胀、腹痛、畏寒、骤然高热、腹部包块等（E错）。